引起肉毒中毒最多见的食品是
A. 肉制品
B. 鱼制品
C. 自制发酵食品
D. 豆制品
E. 罐头食品

正确答案：C。自制发酵食品